肺部叩诊出现实音应考虑的疾病是
A. 肺炎
B. 胸膜炎
C. 肺空洞
D. 肺气肿
E. 大量胸腔积液

正确答案：E。大量胸腔积液

解析：肺部叩诊出现实音应考虑的疾病是大量胸腔积液（E对），胸腔积液患者叩诊为浊音或实音，当积液量大时，叩诊即为实音。肺炎（A错）由于胸膜渗出、黏连，叩诊为浊音。胸膜炎（B错）由于胸膜渗出、黏连，叩诊浊音。肺空洞（C错）叩诊鼓音。肺气肿 叩诊为过清音（D错）。